女性，50岁，因呕吐、腹泻、低热于门诊应用庆大霉素32万U/日，共5天，近日来觉尿量有所减少约700～800ml/日，伴乏力、头晕，试验时检查尿蛋白（+），Hb100g/L，血清钾6.5mmol/L，BUN33.5mmol/L，血肌酐884mmol/L。最有助于诊断的进一步检查是
A. 肾脏B超
B. 静脉肾盂造影
C. 同位素肾图
D. 肾活检
E. 血气分析

正确答案：D。肾活检

解析：患者已初步诊断为庆大霉素导致急性肾衰竭，应予肾活检（D对）明确导致患者肾衰竭的病因及肾脏的受累情况。肾脏B超（A错）可用于排除肾后性衰竭，患者无相关病史及体征，暂不考虑为肾后性肾衰竭，故该手段非首选。静脉肾盂造影（B错）用于诊尿路梗阻的情况及残存肾功能的情况，且肾衰竭患者不可做静脉肾盂造影，以免导致肾功能进一步恶化。同位素肾图（C错）用于反映肾血流量及肾功能，不能明确诊断患者肾功能衰竭的原因及肾脏受累情况。血气分析（E错）可用于对患者呼吸功能的判定，没有特异性，不用于肾功能衰竭原因的诊断。